对哮喘持续状态的处理哪一项是错误的
A. 吸氧
B. 补液纠正酸中毒
C. 糖皮质激素类静脉滴注
D. 支气管扩张剂
E. 脱敏疗法

正确答案：E。脱敏疗法

解析：哮喘持续（危重）状态的治疗：①吸氧（A对）用面罩或双鼻导管吸氧，氧浓度为40%为宜，每分钟4～5L。②补液纠正酸中毒（B对），一般可给正常生理需要量的2倍；乳酸产生过多而发生代酸，当pH<7.3，PaO₂不高时可使用碱性液体；当PaCO₂增高时应先改善通气，再使用碱性液。③糖皮质激素类静脉滴注（C对）作为儿童危重哮喘治疗的一线用药，应尽早使用，甲基泼尼松龙每次1～2mg/kg，琥珀酸氢化可的松每次5～10mg/kg，每4～6小时静脉滴注1次。④支气管扩张剂（D对）首选吸入治疗，开始可每20分钟一次，一小时以后渐延长时间，1～2小时至4～6小时一次，若无效即刻使用糖皮质激素。脱敏疗法（E错，为本题正确答案）最适用于吸入过敏原引起的过敏性鼻炎或者过敏性哮喘，是一种预防哮喘复发的重要措施。